不属于突发公共卫生事件传染病疫情处置重点注意事项的是
A. 对传染病人和疑似患者必须隔离治疗
B. 疫点、留验点消毒工作按照国家卫健委《消毒技术规范》进行消毒
C. 对不同场所媒介种群及密度进行调查，及时采取有效的杀灭措施
D. 组织专业人员开展心理疏导和心理危机干预工作
E. 应根据疾病的严重程度、传播机制、实现的难易程度和暴露的危险程度，分别采取基本防护、加强防护和严密防护的办法

正确答案：D。组织专业人员开展心理疏导和心理危机干预工作